男，24岁。手背部刀伤，创口出血不止。现场急救处理最简便而有效的止血方法是
A. 前臂止血带止血
B. 立即缝合创口
C. 腕部止血带止血
D. 上臂止血带止血
E. 局部加压包扎

正确答案：E。局部加压包扎

解析：手背部刀伤，创口出血不止可使伤员迅速陷入休克，甚至致死，须及时止血。局部加压包扎（E对）是手外伤创面出血，甚至腕平面的尺、桡动脉断裂出血，最简单而行之有效的止血方法。手外伤止血时禁用止血带在腕平面以上捆扎（ACD错），捆扎过紧、时间过长易导致手指坏死；若捆扎压力不够，只将静脉阻断而动脉未完全阻断，出血会更加严重。创口的缝合需在入院彻底清创和组织修复后才可进行（B错）。